职业性损害应该包括
A. 工伤和职业性疾患
B. 职业病和与工作有关疾病
C. 职业病和工伤
D. 职业病和轻微的健康影响
E. 职业病和轻微的健康效应

正确答案：A。工伤和职业性疾患